成年男性，三月来双下肢无力，双下肢麻木逐渐发展到腰部，背后疼痛且咳嗽时加剧。查体左半侧T5下痛温觉消失；右下肢肌力Ⅲ°，腱反射亢进，Babinski征阳性，右下肢足趾振动觉位置觉消失。病变脊髓处，MRI表现为
A. 脊髓呈梭形膨大，广泛低信号
B. 正常脊髓
C. 脊髓不膨大，髓内广泛点状高信号
D. 脊髓外高信号肿块
E. 中央管扩大呈空腔

正确答案：D。脊髓外高信号肿块

解析：患者成年男性，三月来出现自下而上发展的脊髓损害症状、明显神经根痛、左半侧浅感觉消失、右下肢上运动神经元瘫痪、深感觉消失。结合病史诊断为慢性脊髓受压所致的神经根痛及右侧T2-3水平脊髓半切综合征，可为髓外硬膜内或硬膜外病变压迫脊髓所致（如为髓内病变导致的脊髓压迫的话症状应由病变节段开始由上至下发展）。脊髓外病变常见于脊髓肿瘤，肿瘤处血供丰富，MRI上显示脊髓外高信号肿块（D对B错）。脊髓呈梭形膨大，广泛低信号（A错）和脊髓不膨大，髓内广泛点状高信号（C错）均见于脊髓髓内病变。中央管扩大呈空腔（E错）见于脊髓空洞症。